中药密丸蜡壳至少须标注
A. 【贮藏】
B. 【规格】
C. 【药品名称】
D. 【生产批号】
E. 【有效期】

正确答案：C。【药品名称】